最常见的后纵隔肿瘤是
A. 脂肪瘤
B. 神经源性肿瘤
C. 淋巴瘤
D. 胸腺瘤
E. 畸胎瘤

正确答案：B。神经源性肿瘤

解析：最常见的后纵隔肿瘤是神经源性肿瘤（B对）。脂肪瘤（A错）在纵膈肿瘤中十分少见；淋巴瘤（C错）多位于后上纵隔；胸腺瘤（D错）多位于前上纵隔；畸胎瘤（E错）多位于前纵隔。